孕期心理保健方法不正确的是
A. 自我调适情绪
B. 营造健康的怀孕环境
C. 用药调整
D. 保持生活规律
E. 及时宣泄紧张的心理

正确答案：C。用药调整

解析：本题考查孕期心理保健方法。孕期心理保健不建议用药调整（C错，为本题正确答案），可以通过自我调适情绪（A对）、营造健康的怀孕环境（B对）、保持生活规律（D对）、及时宣泄紧张的心理（E对）等方式使孕期心理健康。